还原当量经琥珀酸氧化呼吸链可得
A. 1.5分子ATP
B. 2.5分子ATP
C. 2分子ATP
D. 3分子ATP
E. 5分子ATP

正确答案：A。1.5分子ATP